流行性出血热的表现是
A. 高热、剧烈头痛、皮肤瘀斑、脑膜刺激征
B. 高热、休克、惊厥、呼吸衰竭
C. 高热、低血压性休克、出血、肾损害
D. 高热、目红、腿痛、淋巴结肿大
E. 寒战发热，交替出现，休作有时

正确答案：C。高热、低血压性休克、出血、肾损害

解析：流行性出血热典型病例病程中有发热期、低血压休克期、少尿期、多尿期和恢复期的五期经过。发热期主要表现为发热、全身中毒症状、毛细血管损伤和肾损害（C对）。低血压休克期一般发生在第4-6病日，迟者8-9病日出现，多数患者在发热末期或热退同时出现血压下降，少数在热退后发生。少尿期常继低血压休克期而出现，亦可与低血压休克期重叠或由发热期直接进入本期，少尿期主要表现为尿毒症、酸中毒和水、电解质紊乱，严重患者可出现高血容量综合征和肺水肿。多尿期为新生的肾小管重吸收功能尚未完善，加上尿素氮等潴留物质引起高渗性利尿作用，使尿量明显增加。恢复期经过多尿期后，尿量恢复为2000ml以下，精神食欲基本恢复，一般尚需1-3个月体力才能完全恢复。